肝性脑病的假性神经递质学说中的假性神经递质是指
A. 苯乙胺和酪胺
B. 多巴胺和苯乙醇胺
C. 苯乙胺和苯乙醇胺
D. 苯乙醇胺和羟苯乙醇胺
E. 酪胺和羟苯乙醇胺

正确答案：D。苯乙醇胺和羟苯乙醇胺

解析：肝性脑病的假性神经递质学说中的假性神经递质是指苯乙醇胺和羟苯乙醇胺（D对）。